乳牙钙化的时间
A. 胚胎2个月
B. 胚胎5～6个月
C. 胚胎8～12个月
D. 新生儿1～6个月
E. 婴儿7～12个月

正确答案：B。胚胎5～6个月

解析：本题考查牙齿发育。乳牙钙化的时间胚胎5～6个月（B对）。乳牙牙胚的发生是在胚胎两个月开始的，5～6个月开始钙化，在出生之前乳牙钙化就基本完成了，最晚也会在出生之后一年内完成，乳牙在萌出之前钙化基本上都已经完成了。